心为“君主之官”的理论依据是
A. 心总统意志
B. 心主血脉
C. 心主神志
D. 心主情志
E. 心总统魂魄

正确答案：C。心主神志

解析：本题考查心为“君主之官”的理论依据，属于理解记忆内容。因为心藏神，又称主神明或主神志，是指心有统帅全身脏腑、经络、形体、官窍的生理活动和主司精神、意识、思维、情志等心理活动的功能。故《素问· 灵兰秘典论》说：“心者，君主之官也，神明出焉”（C对，B错）。因为《素问·宣明五气》所说：“心藏神，肺藏魄，肺藏魄，肝藏魂，脾藏意，肾藏志。”意志魂魄不属于新，不能用于解释心为“君主之官”，故（AE错）。因为五脏精气可以产生相应的情志活动，不能笼统的归纳为心主情志（D错）。